男性，60岁，咳嗽5年，呼吸困难加重7天，桶状胸，X线示：肺透过度增强，肋间隙增宽，横膈下降RV/TLC%=40%MVV占顶计值50%，FEV₁/FVC%为55%，该患者最恰当的诊断为
A. 代偿性肺气肿
B. 老年性肺气肿
C. 阻塞性肺气肿
D. 间质性肺气肿
E. 旁间隔性肺气肿

正确答案：C。阻塞性肺气肿

解析：慢性阻塞性肺炎又称阻塞性肺气肿，系终末细支气管远端部分（包括呼吸性细支气管、肺泡管、肺泡囊和肺泡）膨胀，并伴有气腔壁的破坏。阻塞性肺气肿的早期诊断较不易，应结合病史、体征、胸部X线检查及肺功能检查综合判断。凡有逐渐加重的气急史，肺功能测验示残气及残气/肺总量增加，第一秒用力呼气量/用力肺活量减低，最大通气量降低，气体分布不匀，弥散功能减低；经支气管扩张剂治疗，肺功能无明显改善，诊断即可成立（C对）。代偿性的肺气肿是一种正常的生理过程，因为肺部分的切除后肺的总面积减少，为了保证身体的氧的需要所以另一侧的肺就会出现代偿性的扩张，从而形成代偿性的肺气肿（A错）。老年性肺气肿的早期诊断应结合病史、体征、胸部X线检查及肺功能检查综合判断。凡有慢性咳嗽、逐渐加重的气急史、残气率（RV/TLC）≥40%、一秒率（FEV₁/FVC）≤60%、最大通气量（MBC）≤预计值的80%、肺弥散量明显下降或肺泡气氮气浓度≥2.5%、经支气管扩张剂治疗肺功能无明显改善，诊断即可成立。中重度肺气肿根据病史、显著的肺气肿体征，加上X线检查典型的肺气肿征，诊断自不困难（B错）。间质性肺气肿是由于肺内压急剧升高时，肺泡壁或细支气管壁破裂，气体进入肺间质的病理状态。成串的小气泡呈网状分布于肺叶间隔、胸膜下，气体可沿细支气管和血管周围组织间隙扩散至肺门、纵隔，甚至胸部皮下引起皮下气肿（D错）。旁间隔性肺气肿在临床上，一般是从X线上显示胸膜下的小圆形低密度区，沿着胸膜、叶间裂、纵隔分布，常伴有较大的胸膜下肺大疱，就叫肺间隔性肺气肿（E错）。